视觉性语言中枢，绝大多数人位于左侧半球的
A. 额中回后部
B. 额下回后部
C. 顶下小的叶角回
D. 距状沟两侧的大脑皮质
E. 颞上回后部

正确答案：C。顶下小的叶角回

解析：视觉性语言中枢，绝大多数人位于左侧半球的顶下小的叶角回（C对）。书写区位于额中回后部（A错）。运动性语言区位于额下回后部（B错）。听觉性语言中枢位于颞上回后部（E错）。